患者，女，6岁，因发热（38.6℃）、头痛、鼻塞、流清涕、咳嗽、无痰就诊。实验室检查：白细胞、中性粒细胞计数正常。临床诊断为普通感冒。根据该患者目前情况，不宜选用的药物是
A. 头孢克洛干混悬剂
B. 感冒清热冲剂
C. 葡萄糖酸锌口服液
D. 维生素C片
E. 复方小儿退热栓

正确答案：A。头孢克洛干混悬剂

解析：本题考查无适应证用药。根据该患者目前情况，不宜选用的药物是头孢克洛干混悬剂（A错，为本题正确答案）。无适应证用药是指在制定治疗方案和开具处方时，药物的适应证与患者病理、病因、病情、临床诊断不相符。该患者目前白细胞、中性粒细胞计数正常，临床诊断为普通感冒，没有并发细菌感染的症状、体征和证据，所以不应使用处方抗生素。而头孢克洛干混悬剂属于头孢菌素类抗菌药物，故不宜选用。感冒清热冲剂（B对）是治疗风寒感冒的常用药物。葡萄糖酸锌口服液（C对）用于治疗缺锌引起的营养不良、厌食症、异食癖、口腔溃疡、痤疮、儿童生长发育迟缓等。维生素C片​（D对）用于预防坏血病。复方小儿退热栓（E对）用于小儿发热，惊悸不安，咽喉肿痛及肺热痰多咳嗽。